人脑不仅反映当前所看到、听到的事物，还能反映过去经历过的事物和想象出来从未见到过的事物，这说明人脑对现实的反映具有的特点是
A. 客观真实性
B. 系统整体性
C. 抽象概括性
D. 间接创造性
E. 主观能动性

正确答案：E。主观能动性